炎性根侧囊肿发生的上皮剩余是
A. 牙板上皮剩余
B. 结合上皮
C. Serres上皮剩余
D. Malassez上皮剩余
E. 缩余釉上皮

正确答案：D。Malassez上皮剩余

解析：Malassez上皮剩余发生根尖周囊肿、残余囊肿和炎性根侧囊肿。掌握“牙源性囊肿”知识点。